根据《麻醉药品和精神药品管理条例》，关于麻醉药品和精神药品定点批发企业应具备条件的说法，错误的是
A. 具有符合条例规定的麻醉药品和精神药品储存条件
B. 符合国家药品监督管理部门公布的定点批发企业布局
C. 具备《药品管理法》规定的开办药品经营企业的条件
D. 单位及其工作人员1年内没有违反药品管理法律、行政法规规定的行为
E. 具有通过网络实施企业安全管理和向药品监督管理部门报告经营信息的能力

正确答案：D。单位及其工作人员1年内没有违反药品管理法律、行政法规规定的行为

解析：本题考查麻醉药品和精神药品定点经营企业必备条件。根据《麻醉药品和精神药品管理条例》，关于麻醉药品和精神药品定点批发企业单位及其工作人员2年内没有违反有关禁毒的法律、行政法规规定的行为（D错，为本题正确答案）。麻醉药品和精神药品定点经营企业必备条件：麻醉药品和精神药品定点批发企业除应当具备《药品管理法》第五十二条规定的药品经营企业的开办条件外（C对），还应当具备下列条件。1.有符合《麻醉药品和精神药品管理条例》规定的麻醉药品和精神药品储存条件（A对）。2.有通过网络实施企业安全管理和向药品监督管理部门报告经营信息的能力（E对）。3.单位及其工作人员2年内没有违反有关禁毒的法律、行政法规规定的行为。4.符合国务院药品监督管理部门公布的定点批发企业布局（B对）。麻醉药品和第一类精神药品的定点批发企业，还应当具有保证供应责任区域内医疗机构所需麻醉药品和第一类精神药品的能力，并具有保证麻醉药品和第一类精神药品安全经营的管理制度。